合理使用非处方药首先应做到
A. 选择疗效确切的药品
B. 正确判断自己的病证
C. 选择质量稳定的药品
D. 选择使用方便的药品
E. 选择说明书已明确标示了药物禁忌的产品

正确答案：B。正确判断自己的病证